Bonwill论述的等边三角形，三个角居于
A. 两侧髁状突的中心及眉间点
B. 两侧髁状突的中心及下颌中切牙的近中接触点
C. 两侧髁状突的中心及上颌中切牙的近中接触点
D. 两侧颞下颌关节凹及上颌中切牙的近中接触点
E. 两侧颞下颌关节凹及下颌中切牙的近中接触点

正确答案：B。两侧髁状突的中心及下颌中切牙的近中接触点

解析：（扩展内容）Bonwill三角，下颌骨双侧髁突中心与下颌中切牙近中切角接触点相连，恰构成一个等边三角形，其边长为10.16cm，称之为Bonwill三角。掌握“（牙合）分类及临床意义与面部结构”知识点。